下面是关于儿童、青少年单纯性肥胖的描述，错误的表达是
A. 单纯性肥胖是一种营养代谢性疾病
B. 儿童肥胖症相关的一些引起心血管疾病的危险因素和成人肥胖症表现一致
C. 单纯性肥胖对儿童心理健康的影响比生理损害更严重
D. 7~18岁学龄儿童青少年体重指数24和28为超重和肥胖界值点
E. 儿童青少年时期的肥胖大多为单纯性肥胖

正确答案：D。7~18岁学龄儿童青少年体重指数24和28为超重和肥胖界值点